普查是指
A. 对某人群的系统追踪观察
B. 对某人群中的部分人进行调查
C. 对某人群中的每个人进行调查
D. 以发现隐性感染为目的的调查
E. 对某人群的大部分人进行筛查

正确答案：C。对某人群中的每个人进行调查

解析：本题考查普查的概念。普查即全面调查，是指在特定时点或时期内、特定范围内的全部人群（C对ABDE错）（总体）作为研究对象的调查。这个特定时点应该较短。特定范围是指某个地区或某种特征的人群。